教学楼内洗手盆应
A. 每20人1个
B. 每25人1个
C. 每40人1个
D. 每50人1个
E. 每90人1个

正确答案：E。每90人1个